提高药物稳定性的方法有
A. 对水溶液不稳定的药物，制成固体制剂
B. 为防止药物因受环境中的氧气、光线等影响，制成微囊或包合物
C. 对遇湿不稳定的药物，制成包衣制剂
D. 对不稳定的有效成分，制成前体药物
E. 对生物制品，制成冻干粉制剂

正确答案：A、B、C、D、E。对水溶液不稳定的药物，制成固体制剂；为防止药物因受环境中的氧气、光线等影响，制成微囊或包合物；对遇湿不稳定的药物，制成包衣制剂；对不稳定的有效成分，制成前体药物；对生物制品，制成冻干粉制剂

解析：本题考查药物制剂稳定化方法。①制成固体制剂：凡在水溶液中不稳定的药物，制成固体制剂可显著改善其稳定性（A对）；②制成微囊或包合物：采用微囊化和包合技术，可防止药物因受环境中的氧气、湿度、水分、光线的影响而降解，或因挥发性药物挥发而造成损失，从而增加药物的稳定性（B对）；③采用直接压片或包衣工艺：对一些遇湿热不稳定的药物压片时，可采用粉末直接压片、结晶药物压片或干法制粒压片等工艺（C对）；将有效成分制成前体药物，也是提高其稳定性的一种方法（D对）；药物制剂在制备过程中，往往需要加热溶解、干燥、灭菌等操作，此时应考虑温度对药物稳定性的影响，制订合理的工艺条件。如对热不稳定的药物灭菌时，一般应选择高温短时间灭菌，灭菌后迅速冷却。那些对热特别敏感的药物，如某些抗生素、生物制品，则采用无菌操作及冷冻干燥（E对）。